早产儿生后3个月内应每日补充维生素D制剂的量为
A. 10μg
B. 15μg
C. 20μg
D. 25μg
E. 30μg

正确答案：C。20μg

解析：本题考查维生素D缺乏的预防措施。早产儿生后即应补充维生素D800IU/d（20μg/d）（C对ABDE错），3个月后改为400IU/d（10μg/d）。